137-1990）》规定，人均绿地面积标准为
A. ≥10.0m²/人
B. ≥9.0m²/人
C. ≥8.0m²/人
D. ≥7.0m²/人
E. ≥6.0m²/人

正确答案：B。≥9.0m²/人

解析：本题考查人均绿地面积标准。我国《城市用地分类与规划建设用地标准（GBJ 137-90）》规定，人均绿地面积标准为≥9.0m²/人（其中公共绿地≥7.0m²/人）（B对ACDE错）。